处理阑尾断端不宜采用的是
A. 单纯结扎
B. 结扎加荷包缝合包埋
C. 单纯荷包缝合包埋
D. 包埋加系膜脂肪覆盖
E. 断端直接用石炭酸烧灼

正确答案：E。断端直接用石炭酸烧灼

解析：行阑尾切除术时应妥善处理阑尾残端，否则术后易发生残端瘘。石炭酸（一般指苯酚）可用于手术器械消毒、皮肤杀菌与止痒，其穿透力强，对组织有较强的腐蚀性和刺激性，不能用于处理阑尾残端，以免腐蚀盲肠壁引起肠瘘（E错，为本题正确答案）。对于急性单纯性阑尾炎，可行单纯结扎术（A对），也可选择单纯荷包缝合包埋（C对）或结扎加荷包缝合包埋（B对），以减轻污染腹腔污染、促进愈合。对于急性化脓性、坏疽性或合并穿孔等病情较重，结扎及荷包包埋不满意者，可用系膜、脂肪组织等覆盖残端，以减少粘连形成、防止术后残端瘘（D对）。